喹诺酮类药物的临床应用特点
A. 抗菌谱广
B. 抗菌活性强
C. 口服吸收良好
D. 与其他类别抗菌药之间无交叉耐药
E. 以上均正确

正确答案：E。以上均正确

解析：氟喹诺酮类具有抗菌谱广、抗菌活性强、口服吸收良好、与其他类别的抗菌药之间无交叉耐药等特点。但是临床存在滥用的倾向。掌握“喹诺酮类”知识点。